每次哺乳时，母乳中呈先高后低变化的营养成分是
A. 矿物质
B. 维生素
C. 脂肪
D. 蛋白质
E. 碳水化合物

正确答案：D。蛋白质

解析：每次哺乳过程乳汁的成分亦随时间而变化。如将哺乳过程分为三部分，即第一部分分泌的乳汁脂肪低而蛋白质高，第二部分乳汁脂肪含量逐渐增加而蛋白质含量逐渐降低，第三部分乳汁中脂肪含量最高。所以先高后低的蛋白质（D对）。脂肪（C错）是先低后高。矿物质（A错）、维生素（B错）、碳水化合物（E错）都不是哺乳过程中乳汁成分变化的主要物质。